可能不会通过公共场所的人群流动引起大规模流行的疾病是
A. SARS
B. 流行性脑脊髓膜炎
C. 流行性感冒
D. 肺结核
E. 艾滋病

正确答案：E。艾滋病

解析：本题考查可能会通过公共场所的人群流动引起大规模流行的疾病。可能会通过公共场所的人群流动引起大规模流行的疾病有流行性感冒（C对）、百日咳、流行性脑脊髓膜炎（B对）、肺结核（D对）、严重急性呼吸道综合征（SARS）（A对）等呼吸道传染病。艾滋病（E错，为本题正确答案）是由感染艾滋病病毒（HIV）引起的机体免疫功能缺陷，其传播途径为性接触、血液和母婴传播，不会通过公共场所的人群流动引起大规模流行。